修复体损坏的原因以瓷修复体和前牙多见的是
A. 外伤
B. 制作因素
C. 材料因素
D. 磨耗过多
E. （牙合）力过大

正确答案：A。外伤

解析：外伤，如受外力、咬硬物，以瓷修复体和前牙多见。掌握“修复体戴入后的问题及处理”知识点。